用于检测血清和脑脊液的内毒素，有助于革兰阴性细菌感染诊断的是
A. 血常规
B. 脑脊液常规
C. 细菌培养
D. 溶解物实验
E. 抗体检测

正确答案：D。溶解物实验

解析：鲎溶解物试验用于用于检测血清和脑脊液的内毒素，有助于革兰阴性细菌感染的诊断（D对）。